男，56岁，大量饮酒后剧烈呕吐，呕吐物先为胃内容物，后呕吐200ml鲜血。最可能的诊断为
A. 急性糜烂性胃炎
B. 应激性溃疡
C. 食管贲门黏膜撕裂综合征
D. 反流性食管炎合并出血
E. 十二指肠合并出血

正确答案：C。食管贲门黏膜撕裂综合征

解析：食管贲门黏膜撕裂综合征指的是患者由于剧烈频繁的恶心或者呕吐，导致腹内压力骤然提升，造成食管远端或贲门处的黏膜和/或黏膜下层撕裂，引起上消化道出血为主的的疾病，该病好发于中年男性，最常见的原因为酗酒后的剧烈呕吐。中年男性患者（符合此病年龄），大量饮酒后剧烈呕吐（此病常见诱因），呕吐物先为胃内容物，后呕吐200毫升鲜血（此病表现），既往体检，查体BP90/60mmHg（患者出血量大），综上所述，诊断为食管贲门黏膜撕裂综合征（C对）。急性糜烂性胃炎患者一般有上腹痛、胀满、恶心、呕吐、食欲不振（A错）等表现，严重者有呕血、黑便甚至休克。